患者，男，62岁，无吸烟饮酒史，患高血压、高脂血症数年，未治疗。半年前就诊，查肝肾功能正常，按医嘱服用阿托伐他汀、氨氯地平。服药一个月后复查肝功能结果显示AST145U/L，ALT134U/L，排除了其它疾病因素后，停用阿托伐他汀，肝功能逐步恢复正常。一个月后，改用普伐他汀，再次出现肝功能异常。肝功能异常的不良反应与他汀类药物之间的因果关系应评价为
A. 很可能
B. 肯定
C. 可能
D. 可能无关
E. 待评价

正确答案：B。肯定

解析：本题考查因果关系评价。肝功能异常的不良反应与他汀类药物之间的因果关系应评价为肯定（B对）。肯定评价结果是指：用药及反应发生时间顺序合理；停药以后反应停止，或迅速减轻或好转；再次使用，反应再现，并可能明显加重；有文献资料佐证；排除原患疾病等其它混杂因素影响。题干中患者用药及不良反应出现的顺序符合肯定评价的内容。很可能（A错）是指无重复用药史，或虽然有合并用药，但基本可排除合并用药导致反应发生的可能性。可能（C错）是指用药与反应发生时间关系密切，同时有文献资料佐证；但引发ADR的药品不止一种，或原患疾病的病情进展因素不能排除。可能无关（D错）是指ADR与用药时间相关性不密切，反应表现与已知该药ADR不相吻合，原患疾病发展同样可能有类似的临床表现。待评价（E错）是指报告内容填写不齐全，等待补充后再评价；或因果关系难以定论，缺乏文献资料佐证。